足三阳经主治相同的是
A. 胸部病神志病
B. 咽喉病热病
C. 神志病热病
D. 前阴病妇科病
E. 神志病脏腑病，妇科病

正确答案：C。神志病热病

解析：足阳明经主治前头、口齿、咽喉、胃肠病，足少阳经主治侧头、耳、项、胁肋、胆病。足太阳经主治后头、项、背腰、肛肠病。足少阳经和足太阳经共同主治眼病。足三阳经共同主治神志病、热病（C对）。